服用时需限制饮水的药物是
A. 止咳糖浆
B. 二羟丙茶碱
C. 熊去氧胆酸
D. 利托那韦
E. 阿仑膦酸钠

正确答案：A。止咳糖浆

解析：本题考查限制饮水的药物。服用时需限制饮水的药物是止咳糖浆（A对）。止咳糖浆会黏附在发炎的咽喉部而发挥作用，用后应少喝水，避免将局部药物冲掉。二羟丙茶碱（B错）、熊去氧胆酸（C错）、利托那韦（D错）、阿仑膦酸钠（E错）宜多饮水。